关于协定处方正确的说法包括
A. 医院药剂科与临床医师根据需要协商制订
B. 适于医院制剂室内大量配制和储备的制剂
C. 它便于控制院内药品的制剂品种和质量
D. 它提高工作效率，减少患者取药等候时间
E. 它可以在同级医疗单位之间互相交流使用

正确答案：A、B、C、D。医院药剂科与临床医师根据需要协商制订；适于医院制剂室内大量配制和储备的制剂；它便于控制院内药品的制剂品种和质量；它提高工作效率，减少患者取药等候时间